一位准备怀孕的妇女，经过孕前检查风疹抗体检测阴性，医生建议需接种风疹疫苗后间隔一段时间方可怀孕。以下间隔的时间合适的是
A. 2周
B. 4周
C. 8周
D. 10周
E. 14周

正确答案：E。14周

解析：本题考查孕前保健的相关内容。妊娠期感染风疹目前没有有效治疗及减少母胎传播的方法，因此风疹疫苗的接种应在怀孕以前，ACOG过去规定接种疫苗后3个月（14周左右）（E对ABCD错）方可妊娠。